某地区开展1～7岁儿童随机双盲麻疹疫苗免疫接种效果观察，结果免疫接种组儿童1000人中发病5人，未免疫组1000人中发病25人，该疫苗保护率为
A. 20‰
B. 0.2
C. 0.67
D. 0.8
E. 0.9

正确答案：D。0.8

解析：疫苗保护率=（对照组发病率-试验组发病率）/对照组发病率，即（25-5）/25=0.8